应激的心理反应不包括
A. 认知反应
B. 情绪反应
C. 行为反应
D. 生理反应
E. 自我防御反应

正确答案：D。生理反应